关于Ⅰ期梅毒的叙述错误的是
A. 有不洁性交史
B. 可出现硬下疳
C. 梅毒血清学阴性
D. 有心血管梅毒
E. 外阴表面溃疡，有浆液性渗出

正确答案：D。有心血管梅毒

解析：梅毒是由梅毒螺旋体引起的传染病，绝大多数通过性交传播（A对），可分为Ⅰ、Ⅱ、Ⅲ期，其中Ⅰ期梅毒发生于梅毒螺旋体侵入人体后3周左右，此时血清中梅毒螺旋体特异性抗体及反应素还未出现，故梅毒血清学阴性（C对）。梅毒螺旋体在侵入部位发生炎症反应，形成下疳，表面发生溃疡，有浆液渗出（E对），因其质硬乃称硬下疳（B对）。有心血管梅毒（D错，为本题正确答案）是梅毒三期表现。